长期应用糖皮质激素引起低血钙，不正确的是
A. 减少小肠对钙的吸收
B. 抑制肾小管对钙的重吸收
C. 促进尿钙排泄
D. 增加钙的利用
E. 对抗维生素D的作用

正确答案：D。增加钙的利用